开放式问题的特点是
A. 容易回答，节省时间
B. 易于设计，适合于不了解的内容的探索性研究
C. 在测量一些等级问题方面有独特优势
D. 所收集的资料便于分析和比较
E. 设计较复杂，易于获取定量资料

正确答案：B。易于设计，适合于不了解的内容的探索性研究

解析：本题考查开放式问题的特点。开放式问题易于设计，适合于不了解的内容的探索性研究（B对ACDE错），可让回答者自由发挥，能收集到生动的资料，回答者之间的一些较细微的差异也可能反映出来，甚至得到意外的发现。